患者，女，29岁。病人每于经前出现小腹疼痛拒按，有灼热感，腰骶胀痛，午后低热，经色黯红，质稠有块，带下黄稠，小便短赤，舌质红，苔黄腻，脉弦数。治疗应首选
A. 龙胆泻肝汤
B. 归肾丸
C. 健固汤
D. 清热调血汤
E. 二阴煎

正确答案：D。清热调血汤

解析：湿热瘀滞经脉，不通则痛，故见病人每于经前出现小腹疼痛拒按，有灼热感，腰骶胀痛；湿热熏蒸，煎熬血分，故见午后低热，经色黯红，质稠有块；热耗津液故见带下黄稠，小便短赤；舌质红，苔黄腻，脉弦数，均为湿热瘀滞证的痛经的表现，治疗应清热利湿，活血止痛，代表方为清热调血汤加减（D对）。龙胆泻肝汤（A错）可以清泻肝胆实火，清利肝经湿热，用于治疗肝胆实火上炎证和肝经湿热下注证。归肾丸（B错）可以滋补肾阴，用于治疗肾阴不足，精衰血少，腰膝酸软，形容憔悴，阳痿遗精。健固汤（C错）可以补脾气以固脾血，用于治疗妇人之脾气亏虚，行经前泄泻。二阴煎（E错）可以清心泻火，养阴安神，用于治疗心经有热，水不制火，惊狂失志，多言多笑，喜怒无常。